患者，女，25岁，痛经，应选用的药物是
A. 山莨菪碱
B. 布洛芬
C. 麦角胺咖啡因
D. 卡马西平
E. 吗啡

正确答案：B。布洛芬

解析：本题考查治疗痛经的药物。患者，女，25岁，痛经，应选用的药物是布洛芬（B对）。布洛芬为前列腺素合成酶抑制剂，可通过抑制前列腺素合成酶的活性而减少前列腺素产生，从而减轻或消除痛经。山莨菪碱（A错）用于内脏平滑肌痉挛引起的绞痛。麦角胺咖啡因（C错）用于反复性偏头痛。卡马西平（D错）是三叉神经痛首选药。吗啡（E错）用于其他镇痛药无效的急性锐痛，如严重创伤、战伤、烧伤、晚期癌症等疼痛。